银汞合金调制中受潮可导致
A. 强度下降
B. 蠕变值下降
C. 体积收缩
D. 产生延缓膨胀

正确答案：D。产生延缓膨胀

解析：本题考查银汞合金的性能-体积变化。银汞合金调制中受潮可导致延缓膨胀（D对），一般发生在充填后3～5天。汞含量过多等原因会引起银汞合金的强度下降（A错）。汞含量降低等原因，蠕变值下降（B错）。调和研磨时间越长，银汞合金的体积收缩越大（C错）。